流行性脑脊髓膜炎的综合性预防措施正确的是
A. 早期发现和隔离治疗病人
B. 流行期间儿童可以到拥挤的公共场所
C. 对接触者不必给予处置
D. 密切接触者需观察3天
E. 国内流行菌群以C群为主

正确答案：A。早期发现和隔离治疗病人